粮食加工精度过高，淘米过度，加碱煮沸均可损失或破坏
A. 维生素A
B. 维生素D
C. 碳水化合物
D. B族维生素
E. 脂肪

正确答案：D。B族维生素

解析：本题考查食物营养价值的影响因素。粮食加工精度过高，淘米过度，加碱煮沸均可损失或破坏B族维生素（D对ABCE错）。